巨细胞肉芽肿X线表现为
A. 呈现为境界明显的密度减低区，有时表现为多房性骨吸收
B. 颌骨膨胀病变部位边缘模糊，不整齐，下颌骨可形成囊肿样腔洞
C. 虫蚀状骨吸收，有局灶性阻射影，伴有骨新生时，则有骨硬化的表现
D. 圆形界限清楚的阻射区，局限于一个或两个牙的根尖区，与牙根容易区分
E. 病变骨区阻射性降低，呈磨玻璃样改变，病变与周围正常骨的界限不明显

正确答案：A。呈现为境界明显的密度减低区，有时表现为多房性骨吸收

解析：巨细胞肉芽肿病变好发于20～30岁下颌骨的前牙区，女性稍多。颌骨吸收破坏，并使颌骨膨隆，常引起牙的位置异常、松动或脱落。X线呈现为境界明显的密度减低区，有时表现为多房性骨吸收。掌握“结核性骨髓炎及放射性骨髓炎”知识点。